下列属于阳离子型表面活性剂的是
A. 司盘20
B. 十二烷基苯磺酸钠
C. 苯扎溴铵
D. 卵磷脂
E. 吐温80

正确答案：C。苯扎溴铵

解析：本题考查表面活性剂。苯扎溴铵（C对）属于阳离子表面活性剂；司盘20（A错）是非离子表面活性剂；十二烷基苯磺酸钠（B错）是阴离子表面活性剂；卵磷脂（D错）是两性离子表面活性剂；吐温80（E错）是非离子表面活性剂。